疾病预防措施中，EPI是指
A. 流行病学
B. 预防接种
C. 冷链
D. 被动免疫
E. 扩大免疫计划

正确答案：E。扩大免疫计划